下列哪项与龈下牙石的形成有关
A. 龈上菌斑
B. 附着性龈下菌斑
C. 非附着性龈下菌斑
D. 白垢
E. 食物碎屑

正确答案：B。附着性龈下菌斑

解析：本题考查与龈下牙石的形成有关的牙菌斑生物膜。牙石的形成包括3个步骤，即获得性薄膜的形成，菌斑成熟和矿物化，其中菌斑是矿化的核心。附着性龈下菌斑（B对）紧密的附着在牙面，作为矿化的核心，参与龈下牙石的形成。龈上菌斑作为龈上牙石矿化的核心在来源于唾液中矿化成分的参与下形成（A错）龈上牙石。非附着龈下菌斑位于附着性龈下菌斑的表面或直接与龈沟上皮、袋内上皮接触（C错）为结构松散的菌群，在牙周炎快速进展时，非附着龈下菌斑明显增多，毒力增强，与牙槽骨的快速破坏有关，与牙周炎的发生发展关系密切。白垢（D错），也称软垢，通常沉积在牙面的颈1/3区域。食物碎屑（E错）参与白垢的形成。